经过统计得到c2＞c2,0.05结果，正确的结论是
A. P=0.05，拒绝H0，差异有统计学意义
B. P＞0.05，接受H0的可能性较大
C. P=0.05，接受H0，差异无统计学意义
D. P＜0.05，拒绝H0，差异有统计学意义
E. P＞0.05，接受H0，差异无统计学意义

正确答案：D。P＜0.05，拒绝H0，差异有统计学意义

解析：在χ²检验中，若检验水准为α，当χ²＞χ²α，ν时，P≤α，拒绝H₀，接受H₁，差异有统计学意义（D对）；当χ²＜χ²α，ν时，P＞α，不拒绝H₀，差异无统计学意义。